非处方药给药途径，主要是
A. 以非肠道给药为主
B. 根据病情和医嘱决定
C. 以口服、外用为主
D. 以鼻饲给药为主
E. 以灌肠给药为主

正确答案：C。以口服、外用为主

解析：本题考查非处方给药途径。非处方药给药途径，主要是以口服、外用为主（C对）。以非肠道给药为主（A错），根据病情和医嘱决定（B错），以鼻饲给药为主（D错），以灌肠给药为主（E错）均不符合题意。